地西泮含量测定使用的滴定液是
A. 高氯酸滴定液
B. 溴酸钾滴定液
C. 硫酸铈滴定液
D. 硫代硫酸钠滴定液
E. 乙二胺四醋酸二钠滴定液

正确答案：A。高氯酸滴定液

解析：本题考查含量测定。地西泮含量测定用的滴定液是高氯酸滴定液（A对）属于非水碱量法。溴酸钾滴定液（B错）是溴酸钾法所用，此法属于氧化还原滴定法。铈量法硫酸铈滴定液（C错）是铈量法所用，铈量法是在酸性条件下测定还原性物质的方法。硫代硫酸钠滴定液（D错）是碘量法所用，属于氧化还原滴定法。乙二胺四醋酸二钠滴定液（E错）是配位滴定法所用，一般测定的是金属离子的含量。